男，30岁。上腹痛7天，餐后突然加剧6小时，并很快波及全腹。既往有胃病史。当时查体：全腹压痛，反跳痛，肌紧张，肝浊音界消失，肠鸣音减弱。以下哪项检查最有助于诊断
A. 腹腔穿刺
B. 直肠指检
C. 腹部B超
D. 腹部CT
E. 立位腹部平片

正确答案：E。立位腹部平片

解析：男性青年患者，上腹痛7天，餐后加剧6小时，并很快波及全腹（上腹痛，饱餐等诱因后转移为全腹痛）。既往有胃病史（考虑是否有胃十二指肠溃疡），当时查体：全腹压痛，反跳痛，肌紧张，肠鸣音减弱（考虑为由胃十二指肠穿孔所引起的急性腹膜炎），肝浊音界消失（考虑为胃十二指肠穿孔所引起的腹腔积气所致）。综合病人的病史、查体，入院后最可能的诊断为胃十二指肠溃疡穿孔。立位腹部平片（E对）检查最有助于诊断，该检查相对简便易行，价格低廉，立位腹部平片检查膈下可见新月状游离气体影，有助于该疾病的鉴别诊断。腹腔穿刺（A错）作为腹部损伤的检查，阳性率高达90%以上，对于判断腹腔内脏器有无损伤和那类脏器损伤有很大帮助（P320）。直肠指检（B错）是简单而重要的临床检查方法，对及早发现肛管、直肠癌意义重大。但对于胃十二指肠溃疡诊断并无临床意义。腹腔B超（C错）常用于实质脏器损伤的诊断，操作简便易行，价格低廉，但对于空腔脏器损伤如胃十二指肠溃疡穿孔诊断价值有限。腹部CT（D错）可以清晰的反映腹腔内脏器损伤的情况，但操作较难，价格昂贵，不常用于胃十二指肠溃疡穿孔的诊断。